患儿，男，4岁，因发音不清家长带患儿前来就诊，口腔检查见，患儿舌不能自由前伸，勉强前伸时舌尖成W形，智力发育正常。根据以上诊断，该患儿最佳的治疗方法是
A. 诊治智力发育问题
B. 舌系带修整术
C. 进行心理辅导
D. 纠正不正确的发音
E. 以上均正确

正确答案：B。舌系带修整术

解析：本题考查舌系带过短的治疗。患儿发音不清，舌前伸困难，勉强前伸时舌尖成W形，智力发育正常（A错），综合考虑，引起患儿发音不清最可能的原因是舌系带过短。根据以上诊断，该患儿最佳的治疗方法是舌系带修整术（B对）。舌系带修整术适应症为舌系带过短或其附丽点靠前，影响舌的正常活动者；或者在舌前伸时系带与下颌切牙切缘摩擦，可能导致创伤性溃疡者。该病例未提示患者有心理障碍以及有发音教育不正确，故不需要进行心理辅导（C错）和纠正不正确的发音（D错）。